基托可以加强义齿的固位和稳定作用，其原因描述中错误的是
A. 基托与黏膜之间存在唾液，三者间有吸附力
B. 基托与基牙及邻近牙接触可以形成抵抗义齿移位的力量
C. 基托有防止义齿翘动的间接固位作用
D. 基托进入制锁区
E. 基托进入组织倒凹区

正确答案：E。基托进入组织倒凹区

解析：基托进入倒凹区，致使义齿不能戴入。掌握“局部义齿的设计”知识点。